股骨下端骨折向后移位易损伤
A. 肛动脉
B. 会阴动脉
C. 腘动脉
D. 胆囊动脉
E. 腓动脉

正确答案：C。腘动脉

解析：股骨下端骨折向后移位时，会损伤到腘窝内的结构，即腘动脉（C对）易损伤。